下列除哪项外，均可胸痛
A. 带状疱疹
B. 肺癌
C. 气胸
D. 心包炎
E. 哮喘

正确答案：E。哮喘

解析：引起胸痛的病因主要为胸部疾病，常见有①胸壁疾病（带状疱疹（A对））；②心血管疾病（心包炎（D对））；③呼吸系统疾病（气胸（C对）、支气管肺癌（B对））；④纵隔疾病。哮喘（E错，为本题正确答案）主要表现为发作性伴有哮鸣音的呼气性呼吸困难，患者无胸痛表现。